老师反复教了五遍字母“A”，3岁幼儿所产生的记忆为
A. 感觉性记忆
B. 逻辑性记忆
C. 第一记忆
D. 第二记忆
E. 第三记忆

正确答案：C。第一记忆